颞间隙感染来源是
A. 下颌磨牙的根尖周脓肿
B. 化脓性扁桃体炎
C. 下牙槽神经阻滞麻醉消毒不严
D. 化脓性中耳炎
E. 第一前磨牙的根尖化脓性炎症

正确答案：D。化脓性中耳炎

解析：颞间隙感染来源：常由咬肌间隙、翼下颌间隙、颞下间隙和颊间隙感染扩散引起。耳源性感染（化脓性中耳炎、颞乳突炎）、颞部疖痈以及颞部损伤继发感染均可波及颞间隙。掌握“颞间隙、咽旁间隙感染”知识点。